正常人白天工作时出现的脑电波应为
A. α波
B. β波
C. γ波
D. δ波
E. θ波

正确答案：B。β波

解析：脑电波的波形有α波、β波、γ波、δ波和θ波。α波（A错）：清醒、安静、闭眼及正常血糖范围的情况下出现。β波：在睁眼和大脑皮层处在紧张活动状态时出现，代表皮层处于兴奋状态，因此正常人白天工作时出现的脑电波是β波（B对）。γ波（C错）：在觉醒并专注于某一事时出现。δ波（D错）：成人在入睡后，或处于极度疲劳或麻醉时出现。θ波（E错）：成人困倦时出现。